下列属于选择性5-羟色胺再摄取抑制剂的是
A. 文拉法辛
B. 托莫西汀
C. 氟西汀
D. 米氮平
E. 利培酮

正确答案：C。氟西汀

解析：属于选择性5-羟色胺再摄取抑制剂的是氟西汀（C对）、帕罗西汀、舍曲林、氟伏沙明、西酞普兰和艾司西酞普兰。文拉法辛（A错）和米氮平（D错）属于非SSRIs的新型抗抑郁药。托莫西汀（B错）对5-羟色胺、多巴胺等几乎无亲和力，主要适用于注意缺陷障碍的治疗。利培酮（E错）是氟哌啶醇与5-HA₂A阻滞剂利坦色林化合而成的新型药物，不属于选择性5-羟色胺再摄取抑制剂。